女性，59岁。绝经8年，近1周白带带血丝，妇科检查；宫颈中度糜烂，子宫后倾稍小，双侧附件未见异常，宫颈刮片细胞学检查巴氏Ⅲ级，考虑最可能的诊断为
A. 子宫内膜癌
B. 子宫颈癌
C. 绒毛膜癌
D. 宫颈糜烂
E. 侵蚀性葡萄胎

正确答案：B。子宫颈癌

解析：女性，59岁，绝经8年，近1周白带带血丝（子宫颈癌老年患者常为绝经后不规则阴道流血），妇科检查；宫颈中度糜烂（子宫颈微小浸润癌可无明显病灶，宫颈可有糜烂样改变），宫颈刮片细胞学检查巴氏Ⅲ级（可疑癌），综合患者的年龄、临床表现及细胞学检查，可诊断为子宫颈癌（B对）。子宫内膜癌（A错）也会有阴道不规则流血的表现，诊断性刮宫或宫腔镜检查有助于确诊（P316）。宫颈糜烂（D错）宫颈刮片细胞学检查通常为巴氏Ⅱ级。绒毛膜癌（C错）和侵蚀性葡萄胎（E错）为妊娠滋养细胞肿瘤，葡萄胎妊娠后可继发侵蚀性葡萄胎或绒癌，而非葡萄胎妊娠后只继发绒癌，本例患者已绝经8年，根据细胞学检查和病史可鉴别（P338）。